简略寿命表中nqx表示
A. x~岁年龄组人口在n年内的生存率
B. n岁年龄组人口在x年内的死亡概率
C. x~岁年龄组人口在n年内的平均死亡率
D. 已经活到x岁的尚存者在今后n年内的生存概率
E. 已经活到x岁的尚存者在今后n年内的死亡概率

正确答案：E。已经活到x岁的尚存者在今后n年内的死亡概率